性平，既祛风湿，又利水的药是
A. 木瓜
B. 秦艽
C. 桑枝
D. 络石藤
E. 臭梧桐

正确答案：C。桑枝

解析：本题考查的是桑枝的性味归经与功效。性平，既祛风湿，又利水的药是桑枝（C对）。桑枝：【性味归经】苦，平。归肝经。【功效】祛风通络，利水。木瓜（A错）：【性味归经】酸，温。归肝、脾经。【功效】舒筋活络，化湿和中，生津开胃。秦艽（B错）：【性味归经】苦、辛，微寒。归胃、肝、胆、大肠经。【功效】祛风湿，舒筋络，清虚热，利湿退黄。络石藤（D错）：【性味归经】苦，微寒。归心、肝经。【功效】祛风通络，凉血消肿。臭梧桐（E错）：【性味归经】辛、苦，凉。归肝经。【功效】祛风湿，通经络，降血压。